维持阴道正常酸性环境的主要菌群是
A. 葡萄球菌
B. 肠球菌
C. 大肠埃希菌
D. 乳杆菌
E. 棒状杆菌

正确答案：D。乳杆菌

解析：维持阴道正常酸性环境的主要菌群是乳杆菌（D对）。生理情况下，雌激素使阴道上皮增生变厚并增加细胞内糖原含量，阴道上皮细胞分解糖原为单糖，阴道乳杆菌将单糖转化为乳酸，维持阴道正常的酸性环境。